传染性非典型肺炎的主要传染源为
A. 隐性感染者
B. SARS患者
C. 潜伏期感染者
D. 慢性感染者
E. 康复的病人

正确答案：B。SARS患者

解析：SARS是由SARS冠状病毒引起的急性呼吸道传染病，其传染性强、、病情严重。SARS患者（B对）为其主要传染源，主要通过短距离飞沫、接触患者呼吸道分泌物及密切接触传播。SARS～CoV感染以显性感染为主，存在症状不典型的轻型患者和隐性感染患者。隐性传染者（A错）是否作为传染源，迄今尚无足够的资料佐证。潜伏期患者（C错）传染性低或无传染性，作为传染源意义不大。本病未发现慢性感染者（D错）；康复的病人（E错）无传染性。